为了预防口腔癌的发生，定期检查的对象是40岁以上，吸烟量约为
A. 4支/d
B. 8支/d
C. 10支/d
D. 15支/d
E. 20支以上/d

正确答案：E。20支以上/d

解析：本题考查口腔癌的预防。为了预防口腔癌的发生，定期检查的对象是40岁以上，吸烟量约为20支以上/d（E对）。口腔癌的危险度与吸烟量、吸烟时间的长短成正相关。假设不吸烟的危险度是1，每天吸10～19支，危险度上升为6.0，每天吸20支以上危险度为7.7，每天吸40支以上危险度高达12.4；吸烟时间越长，发生口腔癌的危险度越高。